不符合《精神卫生法》规定条件的医疗机构擅自从事精神障碍诊断的，应罚款
A. 处5千元以上
B. 处5千元以，上1万元以下
C. 处1千元以上2万元以下
D. 处2万元以上
E. 处5万元以上

正确答案：B。处5千元以，上1万元以下

解析：本题考查擅自从事精神障碍诊断、治疗的法律责任。不符合《精神卫生法》规定条件的医疗机构擅自从事精神障碍诊断的，应罚款处5千元以，上1万元以下（B对）。不符合《精神卫生法》规定条件的医疗机构擅自从事精神障碍诊断、治疗的，由县级以上人民政府卫生行政部门责令停止相关诊疗活动，给予警告，并处5000元以上1万元以下罚款，有违法所得的，没收违法所得；对直接负责的主管人员和其他直接责任人员依法给予或者责令给予降低岗位等级或者撤职、开除的处分；对有关医务人员,吊销其执业证书。